足少阴肾经与手厥阴心包经的循行交接部位是
A. 肺内
B. 腹中
C. 胸中
D. 心中
E. 目旁

正确答案：C。胸中

解析：手三阴经从胸走手，手三阳经从手走头，足三阳经从头走足，足三阴经从足走腹（胸）。手太阴肺经在食指与手阳明大肠经交接；手阳明大肠经和足阳明胃经都经过鼻旁；足阳明胃经在足大趾与足太阴脾经交接；足太阴脾经与手少阴心经交接与心中；手少阴心经在小指与手太阳小肠经交接；手太阳小肠经与足太阳膀胱经均通过目内眦；足太阳膀胱经从足小趾斜趋足心与足少阴肾经交接；足少阴肾经与手厥阴心包经交接于胸中（C对）；手厥阴心包经在无名指与手少阳三焦经交接；手少阳三焦经与足少阳胆经均通过目内眦；足少阳胆经从足跗上斜趋足大趾丛毛处与足厥阴肝经交接；足厥阴肝经与手太阴肺经交接于肺中。